网织红细胞绝对值减低，最常见于
A. 缺铁性贫血
B. 再生障碍性贫血
C. 阵发性睡眠性血红蛋白尿
D. 特发性血小板减少性紫癜
E. 巨幼细胞性贫血

正确答案：B。再生障碍性贫血

解析：再生障碍性贫血中造血干细胞减少或缺陷导致网织红细胞明显减少，网织红细胞绝对值减少（B对）。缺铁性贫血中网织红细胞大多正常或轻度升高，Hb一般小于正常值（A错）。阵发性睡眠性血红蛋白尿它表现为网织红细胞高于正常（C错）。特发性血小板减少性紫癜表现为血小板数量明显减少，网织红细胞数大出血后可增多（D错）。巨幼细胞性贫血网织红细胞可正常或轻度升高（E错）。